前瞻性队列研究要求
A. 随机分组
B. 前瞻性观察
C. 两者均是
D. 两者均否

正确答案：B。前瞻性观察

解析：本题考查前瞻性队列研究的特点。前瞻性队列研究研究对象的分组是根据研究对象现时的暴露状况而定的，此时研究的结局还没有出现，需要前瞻观察（B对ACD错）一段时间才能得到。